下列各项，可用阴阳消长来解释的是
A. 阳虚则寒
B. 阳长阴消
C. 寒者热之
D. 阴损及阳
E. 阴胜则阳病

正确答案：B。阳长阴消

解析：在阴阳双方彼此对立制约的过程中，阴与阳之间可出现某一方增长而另一方消减，或某一方消减而另一方增长的互为消长的变化，前者称为阳长阴消或阴长阳消，后者称为阳消阴长或阴消阳长（B对）。阳虚则寒（A错）、阴胜则阳病（E错）是基于阴阳对立制约。寒者热之阴损及阳（D错）是基于阴阳互根互用。寒者热之（C错）是治疗原则。